用吲哚环替代六氢萘环，第一个通过全合成得到的药物是
A. 阿托伐他汀钙
B. 氟伐他汀钠
C. 瑞舒伐他汀钙
D. 洛伐他汀
E. 普伐他汀钠

正确答案：B。氟伐他汀钠

解析：本题考查氟伐他汀钠的合成。氟伐他汀钠（B对）是第一个通过全合成得到的他汀类药物，用吲哚环替代洛伐他汀分子中的双环，并将内酯环打开与钠成盐后得到氟伐他汀钠。